社区卫生服务主要为社区群众提供
A. 基本医疗、预防保健和病后康复服务
B. 专科服务、预防保健和病后康复服务
C. 预防保健、基本医疗和专科服务
D. 基本医疗、专科服务和病后康复服务
E. 以上均不对

正确答案：A。基本医疗、预防保健和病后康复服务

解析：本题考查社区卫生服务的用途。社区卫生服务是融预防、保健、康复、健康教育、计划生育技术服务和一般常见病、多发病的诊疗服务（A对BCDE错）等为一体的，有效、经济、方便、综合、连续的基层服务。